孕妇易出现生理性贫血，主要是因为
A. 血液被稀释
B. 红细胞数量减少
C. 缺铁
D. 营养不良
E. 铜摄入增加

正确答案：A。血液被稀释